可复性牙髓炎的诊断要点为
A. 主诉对温度刺激一过性敏感
B. 无自发痛史
C. 对牙髓电活力测试反应阈值低
D. 有引起牙髓病的牙体缺损或牙周组织损坏
E. 以上都是

正确答案：E。以上都是

解析：主诉对温度刺激一过性敏感，但无自发痛的病史。可找到能引起牙髓病变的牙体病损牙周组织损害。冷刺激时患牙可出现一过性敏感。掌握“可复性、急慢性牙髓炎”知识点。